下列不含味蕾的结构是
A. 轮廓乳头
B. 菌状乳头
C. 软腭的黏膜上皮
D. 丝状乳头
E. 会厌的黏膜上皮

正确答案：D。丝状乳头

解析：轮廓乳头（A对）、菌状乳头（B对）、叶状乳头以及软腭、会厌等处的黏膜上皮（CE对）中含有味蕾，为味觉感受器，具有感受酸、甜、苦、咸等味觉的功能。由于丝状乳头中无味蕾，故无味觉功能（D错，为本题正确答案）